属于低分子溶液剂的有
A. 地高辛口服液
B. 薄荷水
C. 胃蛋白酶合剂
D. 金银花露
E. 颠茄酊

正确答案：A、B、D、E。地高辛口服液；薄荷水；金银花露；颠茄酊

解析：本题考查低分子溶液剂。属于低分子溶液剂的有地高辛口服液（A对）、薄荷水（B对）、金银花露（D对）、颠茄酊（E对）。低分子溶液剂包括：溶液剂、芳香水剂、醑剂、甘油剂、糖浆剂等。地高辛口服液为溶液剂；薄荷水、金银花露为芳香水剂；颠茄酊为酊剂；胃蛋白酶合剂（C错）为高分子溶液剂。